我国的石油多为
A. 无硫油
B. 低硫油
C. 中硫油
D. 高硫油
E. 极高硫油

正确答案：B。低硫油

解析：本题考查我国的石油硫含量。我国的石油资源主要分布在中国东部沿海地区、西部地区和内陆地区，其中以青岛湾、新疆、山西等油田的石油质量最佳，硫含量低于0.5%，属于低硫油（B对ACDE错）。